健康治理的特点包括
A. 治理主体多元化
B. 治理机制多样化
C. 治理策略创新
D. 治理手段多样化
E. 以上都对

正确答案：E。以上都对

解析：本题考查健康治理的特点。健康治理的特点为：①治理主体多元化；②治理机制多样化；③治理策略创新；④治理手段多样化。本题中的选项都对（E对ABCD错）。